患者出现寒战，高热，伴有恶心，乏力，食欲减退，肝区出现疼痛，行辅助检查增强CT出现环形强化，考虑可能的疾病
A. 肝癌
B. 肝脓肿
C. 肝血管瘤
D. 肝囊肿
E. 肝硬化

正确答案：B。肝脓肿

解析：根据题干中辅助检查出现环形强化，环形强化指影像学扫描做增强扫描时病灶周围有一圈造影剂浓集，提示为肝脓肿（B对）。根据患者寒战、高热、恶心、乏力、纳差、肝大、肝区疼痛等症状，不考虑血管瘤、肝癌（AC错）。肝囊肿、肝硬化增强扫描时不会出现环形强化，况且肝硬化会出现肝脏变小（DE错）。